男，38岁。腹痛，反酸9年。1周来症状加重，并出现夜间痛，进食能部分缓解。诊断首先考虑
A. 胃溃疡
B. 肠易激综合征
C. 慢性胃炎
D. 十二指肠球部溃疡
E. 胃溃疡并幽门梗阻

正确答案：D。十二指肠球部溃疡

解析：中年男性患者，既往有腹痛、反酸9年病史（慢性消化系统疾病）。1周来症状加重，并出现夜间痛，进食能部分缓解（节律性上腹饥饿痛与夜间痛），诊断为十二指肠球部溃疡（D对）。胃溃疡（A错）主要表现为餐后痛，1～2小时后缓解。肠易激综合征（P386）（B错）主要与精神、饮食等因素有关，腹痛以下腹和左下腹多见，排便或排气后缓解。慢性胃炎（P355）（C错）大多数患者无症状，可表现为上腹不适、饱胀，也可呈食欲不振，无节律性腹痛。胃溃疡并幽门梗阻（P360）（E错）有明显上腹胀痛，餐后加重，呕吐后腹痛稍缓解，呕吐物为宿食，体检可见胃蠕动波和震水声。